患儿，男，3岁。发热3天，鼻塞流涕，眼睑红赤，泪水汪汪，口腔颊黏膜见有一细小白色疹点，周围红晕，舌苔薄黄。治疗应首选
A. 清解透表汤
B. 宣毒发表汤
C. 银翘散
D. 桑菊饮
E. 透疹发表汤

正确答案：B。宣毒发表汤

解析：麻疹是小儿时期常见的一种急性呼吸道传染病，临床以发热、上呼吸道炎症、结膜炎、麻疹黏膜斑及全身斑丘疹为特征。口腔颊黏膜见有一细小白色疹点，周围红晕，为"麻疹黏膜斑"，结合患儿其他临床表现，故诊断为麻疹。麻毒由口鼻而入，首犯肺卫，邪郁于表，肺气不宜，故发热，鼻塞流涕，舌苔薄黄；热毒初盛，上熏苗窍，故眼睑红赤，泪水汪汪，口腔颊黏膜见有一细小白色疹点，周围红晕，故其证候为邪郁肺卫证，治以辛凉透表，清宣肺卫，方药为宣毒发表汤（B对E错）。清解透表汤（A错）其功用为辛凉透表，清宣肺卫，适用于麻疹之邪入肺胃证。银翘散（C错）其功用为辛凉透表，清热解毒，适用于风疹邪郁肺卫证。桑菊饮（D错）其功用为疏风清热，宣肺止咳，适用于风热咳嗽。